印度博帕尔事件是一起
A. 饮用水污染事件
B. 地面水污染事件
C. 土壤污染事件
D. 大气污染事件
E. 放射性污染事件

正确答案：D。大气污染事件